关于毛细淋巴管的叙述，错误的是
A. 与小的动脉、静脉相通
B. 是物质与气体的交换场所
C. 管壁通透性大于毛细血管
D. 由单层立方上皮构成
E. 除少数器官外遍布全身各处

正确答案：A。与小的动脉、静脉相通

解析：毛细淋巴管以盲端起始于组织间隙，而后汇集成淋巴管，不与小的动、静脉相通（A错，为本题正确答案）。毛细淋巴管仅由单层立体上皮构成（D对），蛋白质细胞碎片，脂类异物等都可进入毛细淋巴管，即淋巴管管壁通透性大于毛细血管（C对），毛细淋巴管除了上皮、角膜、晶状体、软骨、胎盘、脊髓外遍布全身各处（E对）。